治疗社区获得性肺炎时，可覆盖非典型病原体的抗生素是
A. 头孢菌素类
B. 糖肽类
C. 青霉素类
D. 大环内酯类
E. 氨基糖苷类

正确答案：D。大环内酯类

解析：非典型病原体包括军团菌、支原体、衣原体等。社区获得性肺炎常见病原体为肺炎链球菌、支原体、衣原体、流感嗜血杆菌和呼吸道病毒等。综合题目可知，该题考察的是支原体、衣原体感染首选什么药。支原体、衣原体的感染，早期使用适当抗生素可减轻症状及缩短病程，首选大环内酯类抗生素（D对）。头孢菌素类（A错）青霉素类（C错）主要用于肺炎链球菌的感染。糖肽类抗生素（B错）主要用于革兰阳性菌。氨基糖苷类（E错）主要用于肺炎克雷伯的感染。